患者，女，5岁，体重25kg。两天前受凉后发热，最高体温38.9℃，并伴有鼻塞、咳嗽、喷嚏、流鼻涕等感冒症状。家长到药店购买酚麻美敏口服溶液、小儿氨酚黄那敏颗粒、对乙酰氨基酚混悬滴剂和盐酸麻黄碱滴鼻液。关于本病例患者用药教育的方法，错误的是
A. 酚麻美敏口服液与对乙酰氨基酚混悬滴剂都含有对乙酰氨基酚，应避免重复用药
B. 酚麻美敏口服液与盐酸麻黄碱滴鼻液含有相同成分，应避免重复用药
C. 酚麻美敏口服液与小儿氨酚黄那敏颗粒含有相同成分氯苯那敏，应避免重复用药
D. 酚麻美敏口服液与小儿氨酚黄那敏颗粒含有相同成分对乙酰氨基酚，应避免重复用药
E. 小儿氨酚黄那敏颗粒与对乙酰氨基酚混悬滴剂含有相同成分，应避免重复用药

正确答案：B。酚麻美敏口服液与盐酸麻黄碱滴鼻液含有相同成分，应避免重复用药

解析：本题考查用药教育。关于本病例患者用药教育的方法，错误的是酚麻美敏口服液与盐酸麻黄碱滴鼻液含有相同成分，应避免重复用药（B错，为本题正确答案）。酚麻美敏为复方制剂，主要成分有对乙酰氨基酚（A对）、盐酸伪麻黄碱、氢溴酸右美沙芬、马来酸氯苯那敏。盐酸麻黄碱滴鼻液中主要成分是盐酸麻黄碱，两种药物不含有相同成分。小儿氨酚黄那敏颗粒为复方制剂，主要成分有对乙酰氨基酚（DE对），马来酸氯苯那敏（C对），人工牛黄。